调节注射液渗透压的常用附加剂是
A. 亚硫酸钠
B. 氯化钠
C. 甲酚醛树
D. 氢氧化钠
E. 聚山梨酯80

正确答案：B。氯化钠

解析：本题考查的是注射液的附加剂。调节注射液渗透压的常用附加剂是氯化钠（B对）。注射剂的附加剂：配制注射剂时，可根据需要加入适宜的附加剂，如渗透压调节剂、pH调节剂、增溶剂、助溶剂、抗氧剂、抑菌剂、乳化剂、助悬剂等。所用附加剂应不影响药物疗效，避免对检验产生干扰，使用浓度不得引起毒性或明显的刺激性。（1）增溶剂、乳化剂和助悬剂：为了提高注射液中药物的溶解度，或制备乳状液型、混悬液型注射液的需要，在保证安全有效的前提下，可考虑加入适量的增溶剂或乳化剂、助悬剂等。除另有规定外，供静脉用的注射液，慎用增溶剂；椎管内注射用的注射液，不得添加增溶剂。常用增溶剂有聚山梨酯80（E错）、蛋黄卵磷脂、大豆磷脂等；聚山梨酯80、大豆磷脂、蛋黄卵磷脂也可用作乳化剂；甘油可用作助悬剂。（2）防止药物氧化的附加剂：①抗氧剂：抗氧剂是一类易被氧化的还原剂。常用的抗氧剂有亚硫酸钠（A错）、亚硫酸氢钠和焦亚硫酸钠等，一般浓度为0.1%～0.2%。其中亚硫酸钠常用于偏碱性药液，亚硫酸氢钠和焦亚硫酸钠常用于偏酸性药液。②惰性气体：在注射剂的配制、灌封等生产过程中，为防止主药氧化，应在药液或空安瓿空间通惰性气体。常用的惰性气体有二氧化碳和氮气。通入惰性气体应作为处方混合成分在标签中注明。使用二氧化碳时，应注意对药液pH的影响。③金属离子络合剂：有些注射剂，常因药液中含有微量金属离子的存在，而加速主药的氧化、变质，可加入能与金属离子络合的络合物，使与金属离子生成稳定的水溶性络合物，阻止其促进氧化，使药液稳定。常用的金属离子络合剂有乙二胺四乙酸（EDTA）、乙二胺四乙酸二钠（EDTA-2Na）等，常用量为0.03%～0.05%。（3）调节渗透压的附加剂：正常人体血液的渗透压摩尔浓度范围为285～310mOsmol/kg，0.9%氯化钠溶液或5%葡萄糖溶液的渗透压摩尔浓度与人体血液相当。凡与人体血液、泪液渗透压相同的溶液称为等渗溶液。大量注入低渗溶液会导致溶血，因此大容量注射液应调节渗透压。常用的调节渗透压的附加剂有氯化钠、葡萄糖等。（4）调节pH的附加剂：注射剂的pH一般应控制在4.0～9.0之间，大剂量输入的注射液pH应接近中性。常用的调节pH的附加剂有盐酸、枸橼酸、氢氧化钠（D错）、氢氧化钾、碳酸氢钠、缓冲剂磷酸氢二钠和磷酸二氢钠等。加入调节pH附加剂可以减少由于pH不当对机体造成的局部刺激，增加药液的稳定性，增加弱酸或弱碱类药物的溶解度。（5）抑制微生物增殖的附加剂：多剂量包装的注射液可加适宜的抑菌剂。抑菌剂的用量应能抑制注射液中微生物的生长，在制剂确定处方时，该处方的抑菌效力应符合《中国药典》抑菌效率检查法的规定。加有抑菌剂的注射液，仍应采用适宜的方法灭菌。静脉给药与脑池内、硬膜外、椎管内用的注射液均不得加抑菌剂。常用抑菌剂为0.5%苯酚、0.3%甲酚、0.5%三氯叔丁醇、0.01%硫柳汞等。（6）减轻疼痛的附加剂：为减轻注射时的疼痛而加入的附加剂称为止痛剂，一般用于肌内或皮下注射的注射剂。常用的止痛剂有三氯叔丁醇、盐酸普鲁卡因、盐酸利多卡因等。甲酚醛树脂（C错）的作用，2022年考试指南未明确说明。